患儿男性，6岁，高热1天，腹泻6～7次，为黏液性脓血便，腹痛伴里急后重，反复惊厥，逐渐出现昏睡、意识不清，病前吃过未洗的黄瓜，诊断为细菌性痢疾。其临床类型属于下列哪种类型
A. 轻型
B. 普通型
C. 慢性型
D. 重型
E. 中毒型

正确答案：E。中毒型